病人最近数月一直耳闻人语声，讲“要抓他”，非常害怕，病人称，“家中有窃听器、摄像机，马路上有人跟踪，自己完全被控制了。”你认为该病人的症状主要是
A. 思维散漫
B. 被害妄想
C. 被控制感
D. 错觉
E. 关系妄想

正确答案：B。被害妄想

解析：该患者称有人要抓他，自己被人监视、跟踪（坚信自己被某些人迫害，如跟踪、监视）为被害妄想（B对）。思维散漫表现为在交谈时，内容散漫，缺乏主题，话题转换缺乏必要的联系（A错）。被控制感又称物理影响妄想，患者感到自己的思想、情感或意志行为受到某种外界力量的控制而身不由己，如患者经常描述自己被红外线、电磁波、超声波或某种特殊的先进仪器控制（C错）。错觉是对客观事物歪曲的知觉，如患者把输液管看成一条正在吸血的蛇（D错）。关系妄想的患者认为周围环境中所发生的与自己无关的事情均与自己有关，如认为周围人的谈话是在议论自己（E错）。